经煮沸5分钟后可利用的病畜乳是
A. 有明显结核症状的病畜所产乳
B. 患布鲁氏菌病乳牛所产的乳
C. 乳房出现口蹄疫病变（如水泡）的病畜所产乳
D. 乳房局部患有炎症的乳畜所产乳
E. 患炭疽病的乳畜所产乳

正确答案：B。患布鲁氏菌病乳牛所产的乳

解析：本题考查经煮沸5分钟后可利用的病畜乳。患布鲁氏菌病乳牛所产的乳（B对ACDE错），经煮沸5分钟后方可利用。